乙酰水杨酸具有
A. 镇痛作用
B. 抗炎作用
C. 两者皆有
D. 两者皆无

正确答案：C。两者皆有

解析：本题考查乙酰水杨酸的作用。乙酰水杨酸（阿司匹林）为非甾体类抗炎药（C对），具有解热镇痛作用，还具有抗炎抗风湿作用。